一位诊断为慢性牙周炎的牙周病患者，已于2个月前完成牙周基础治疗，现需选择最佳手术方法：袋深5mm，附着龈较窄，牙槽骨水平吸收，骨形态尚可，应选择
A. 冠向复位瓣术
B. 改良Windman术
C. 植骨术
D. 牙周翻瓣术+骨成形术
E. 引导性组织再生术

正确答案：B。改良Windman术

解析：本题考查牙周病的手术治疗-翻瓣术。牙周基础治疗后2个月，若袋深仍在5mm左右，附着龈较窄，牙槽骨水平吸收，骨形态尚可时，可选择改良Windman术（B对）切除病变的袋内壁组织，保留并翻起外侧健康的组织瓣，彻底刮净感染的肉芽组织、根面牙石，再将软组织瓣原位复位，达到使牙周袋变浅、促进骨修复的目的。冠向复位瓣术（A错）适用于不伴有深牙周袋和牙槽骨缺损的牙龈退缩的治疗，当袋深5mm，附着龈较窄，牙槽骨水平吸收时不宜选用。植骨术（C错）是采用骨或骨的替代品等移植材料来修复因牙周炎造成的牙槽骨缺损的方法，适用于二壁及三壁骨下袋或Ⅱ度根分叉病变，当牙槽骨水平吸收，骨形态尚可时不宜选用。牙周翻瓣术+骨成形术（D错）的结合与改良windman术一样，也可达到使牙周袋变浅、促进骨修复的目的，但相比于改良windman术，此种方法创伤较大，当牙槽骨水平吸收，骨形态尚可时不宜选用。引导性组织再生术（E错）适用于窄而深的二壁或三壁骨下袋，Ⅱ度根分叉病变以及局限性牙龈退缩，当牙槽骨水平吸收，骨形态尚可时不作为最佳手术方法。